处方书写龙牡，应付
A. 生龙骨、生牡蛎
B. 煅龙骨、煅牡蛎
C. 炙龙骨、炙牡蛎
D. 生龙骨、煅牡蛎
E. 煅龙骨、生牡蛎

正确答案：B。煅龙骨、煅牡蛎

解析：本题考查的是常见的并开药名。处方书写龙牡，应付煅龙骨、煅牡蛎（B对）。处方药名为龙牡，调配应付煅龙骨、煅牡蛎。处方药名写生龙牡，调配应付生龙骨、生牡蛎（A错）。